某女，40岁。患急性支气管炎，症见身热口渴、咳嗽痰盛、喘促气逆、胸膈满闷。证属表寒里热，宜选用的成药是
A. 二陈丸
B. 止嗽定喘口服液
C. 清肺抑火丸
D. 礞石滚痰丸
E. 半夏天麻丸

正确答案：B。止嗽定喘口服液

解析：本题考查的是止嗽定喘口服液的主治。患急性支气管炎，症见身热口渴、咳嗽痰盛、喘促气逆、胸膈满闷。证属表寒里热，宜选用的成药是止嗽定喘口服液（B对）。止嗽定喘口服液：【主治】表寒里热，身热口渴，咳嗽痰盛，喘促气逆，胸膈满闷；急性支气管炎见上述证候者。二陈丸（A错）：【主治】痰湿停滞导致的咳嗽痰多、胸脘胀闷、恶心呕吐。清肺抑火丸（C错）：【主治】痰热阻肺所致的咳嗽、痰黄黏稠、口干咽痛、大便干燥。礞石滚痰丸（D错）：【主治】痰火扰心所致的癫狂惊悸，或喘咳痰稠、大便秘结。半夏天麻丸（E错）：【主治】脾虚湿盛、痰浊内阻所致的眩晕、头痛、如蒙如裹、胸脘满闷。